治疗风湿性心脏瓣膜病气虚血瘀证，应首选
A. 补阳还五汤
B. 血府逐瘀汤
C. 左归丸
D. 参附汤合生脉散
E. 独参汤合桃仁红花煎

正确答案：E。独参汤合桃仁红花煎

解析：风湿性心脏瓣膜病气虚血瘀证，治宜益气养心，活血通络，首选补气固脱的独参汤合疏肝理气，活血通络的桃仁红花煎（E对）。心肌梗死气虚血瘀证，治宜益气活血，祛瘀止痛，补阳还五汤适宜（A错）。血府逐瘀汤活血化瘀，通络止痛，适用于心肌梗死气滞血瘀证（B错）。左归丸滋阴补肾，填精益髓，适用于真阴不足证（C错）。参附汤益气回阳固脱，主治阳气暴脱证；生脉散益气生津，敛阴止汗，适用于气阴两虚证（D错）。